可产生和分泌抗体的细胞是
A. 浆细胞
B. 中性粒细胞
C. 巨噬细胞
D. NK细胞
E. CTL

正确答案：A。浆细胞